DIC最主要的病理特征是：
A. 凝血物质大量消耗
B. 纤溶亢进
C. 凝血功能障碍
D. 大量微血栓形成
E. 溶血性贫血

正确答案：D。大量微血栓形成

解析：DIC最主要的病理特征是大量微血栓形成（D对）。DIC指在某些致病因子的作用下，大量促凝物质入血，凝血因子和血小板被激活，使凝血酶增多，大量微血栓形成，继而因凝血因子和血小板大量消耗（A错），引起继发性纤溶亢进（B错），机体出现以止、凝血功能障碍（C错）为特征的病理生理过程。主要临床表现为出血、休克、器官功能障碍和微血管病性溶血性贫血（E错）等，是一种危重的综合征。